补骨脂的功效有
A. 补肾壮阳
B. 脱疮生肌
C. 温脾止泻
D. 纳气平喘
E. 养肝明目

正确答案：A、C、D。补肾壮阳；温脾止泻；纳气平喘